患者，男，54岁，因痛风服用非布司他，为增强降尿酸效果，可同时使用的药物是
A. 阿托伐他汀
B. 甲巯咪唑
C. 丙硫氧嘧啶
D. 氢氯噻嗪
E. 碳酸氢钠

正确答案：E。碳酸氢钠

解析：本题考查非布司它。为增强降尿酸效果，可同时使用的药物是碳酸氢钠（E对）。非布司它与碳酸氢钠合用可增强降尿酸效果。阿托伐他汀（A错）属于羟甲基戊二酰辅酶A还原酶抑制剂，对动脉粥样硬化及冠心病的防治产生作用，还能够稳定和缩小动脉粥样硬化的脂质斑块，减少心血管事件发生。甲巯咪唑（B错）属于硫脲类抗甲状腺药，作用机制主要是抑制甲状腺内的过氧化物酶，进而抑制酪氨酸的碘化和偶联，抑制甲状腺激素的生物合成。丙硫氧嘧啶（C错）能抑制过氧化酶系统，使被摄入到甲状腺细胞内的碘化物不能氧化成活性碘，酪氨酸不能碘化；同时，一碘酪氨酸和二碘酪氨酸的缩合过程受阻，以致不能生成甲状腺激素。氢氯噻嗪（D错）为噻嗪类利尿药，通过减少血容量而降压，长期用药则通过扩张外周血管而产生降压作用。